X线透视仅用于
A. 骨髓炎
B. 骨折整复
C. 骨癌
D. 关节炎
E. 以上均不是

正确答案：B。骨折整复

解析：X线透视既可观察骨折整复时部位的形状改变、活动情况，同时可以从不同角度观察病变的部位、形态、大小（B对E错）。骨髓炎局部分层穿刺获得脓球或细菌可确诊（A错）。骨癌可以依靠X线、CT、MRI来诊断（C错）。关节炎根据全身及局部表现，血液及关节液检查阳性以及影像学等辅助检查诊断（D错）。